错者为
A. 在肛门和外生殖器之间
B. 呈菱形
C. 前方为耻骨联合下缘
D. 后方为尾骨尖
E. 无

正确答案：A。在肛门和外生殖器之间

解析：在肛门和外生殖器之间（A错，为本题正确答案）为狭义的会阴；广义会阴呈菱形（B对），前方为耻骨联合下缘（C对），后方为尾骨尖（D对）。